某女，48岁。素体虚弱，时见胸腹刺痛，近日又患崩漏，色暗红，并有少量血块，舌质暗淡，苔薄白。治与化瘀止血、活血定痛，兼以补虚，宜选用的药是
A. 茜草
B. 三七
C. 槐花
D. 艾叶
E. 苎麻根

正确答案：B。三七

解析：本题考查的是三七的功效。素体虚弱，时见胸腹刺痛，近日又患崩漏，色暗红，并有少量血块，舌质暗淡，苔薄白。治与化瘀止血、活血定痛，兼以补虚，宜选用的药是三七（B对）。三七：【功效】化瘀止血，活血定痛。茜草（A错）：【功效】凉血，祛瘀，止血，通经。槐花（C错）：【功效】凉血止血，清肝泻火。艾叶（D错）：【功效】温经止血，散寒止痛。苎麻根（E错）：【功效】凉血止血，清热安胎，利尿，解毒。